下列哪一个脏器通常不发生凝固性坏死
A. 肾
B. 脑
C. 肠
D. 子宫
E. 肺

正确答案：B。脑

解析：凝固性坏死是指当蛋白质变性凝固且溶酶体酶水解作用较弱时，坏死区呈现的灰黄、干燥、质实的状态，多见于肾脏（A对）等。肠（C对）、子宫（D对）和肺（E对）常发生湿性坏疽，而湿性坏疽可为凝固性坏死和液化性坏死的混合物。脑（B错，为本题正确答案）常因缺血缺氧引起液化性坏死，不发生凝固性坏死。